哺乳期妇女禁用的药品是
A. 环丙沙星
B. 磷酸铝
C. 葡萄糖酸钙
D. 双八面体蒙脱石
E. 乳酸菌素

正确答案：A。环丙沙星

解析：本题考查哺乳期妇女用药。哺乳期妇女禁用环丙沙星（A对）。环丙沙星为喹诺酮类药物，对乳儿骨关节有潜在危害，不宜应用。磷酸铝（B错）、葡萄糖酸钙（C错）、双八面体蒙脱石散（D错）、乳酸菌素（E错）都不属于哺乳期禁用药物。